应用高效孕激素和假孕疗法治疗子宫内膜异位症效果较差的是
A. 卵巢巧克力囊肿
B. 子宫直肠陷凹病灶
C. 膀胱的子宫内膜异位
D. 远处转移的子宫内膜
E. 子宫腺肌病

正确答案：E。子宫腺肌病

解析：治疗子宫内膜异位症的常用治疗方法有期待治疗、药物治疗和手术治疗。其中药物治疗包括假孕疗法（雌/孕激素）、假绝经疗法（达那唑）和药物卵巢切除疗法（促性腺激素释放激素激动剂（GnRH-a））。当异位内膜侵犯除子宫外其他部位如卵巢、腹膜、膀胱或远处转移时，可出现卵巢巧克力囊肿（A对）、子宫直肠陷凹病灶（B对）、膀胱的子宫内膜异位（C对）、远处转移的子宫内膜（D对）。高效孕激素和假孕疗法可降低垂体促性腺激素水平，并直接作用于子宫内膜和异位内膜，导致内膜萎缩和经量减少。子宫腺肌病（E错，为本题正确答案）肌层内的异位内膜为不成熟的内膜，属基底层内膜，对孕激素无反应或不敏感，故对高效孕激素和假孕疗法治疗效果较差。